阻止微管解聚的抗癌药有
A. 紫杉醇
B. 长春碱
C. 紫杉碱
D. L-门冬酰胺酶
E. 喜树碱

正确答案：A、C。紫杉醇；紫杉碱